易引起白血病的有机溶剂是
A. 甲苯、二甲苯
B. 苯
C. 三硝基甲苯
D. 米胺、联苯胺
E. 苯二胺、硝基氯苯

正确答案：B。苯